属于良性卵巢肿瘤的是
A. 内胚窦瘤
B. 库肯勃瘤
C. 颗粒细胞瘤
D. 无性细胞瘤
E. 卵泡膜细胞瘤

正确答案：E。卵泡膜细胞瘤

解析：卵泡膜细胞瘤（E对）和颗粒细胞瘤（C错）都属于颗粒细胞-间质细胞瘤，前者良性多见，后者为恶性肿瘤。内胚窦瘤（卵黄囊瘤）（A错）和无性细胞瘤（D错）都属于卵巢生殖细胞的恶性肿瘤。库肯勃瘤（B错）是一种原发于胃肠道的卵巢转移性腺癌。